空气质量预报一般是对未来多长时间污染物浓度的定量预报
A. 6～12小时
B. 12～24小时
C. 24～36小时
D. 24～48小时
E. 36～48小时

正确答案：C。24～36小时

解析：本题考查空气质量预报。空气质量预报是对未来某一区域空气质量的预测，它是建立在区域内目前的环境空气质量状况和未来该区域的污染物排放状况、地形条件、气象因子以及周边地区有关影响区域内空气质量因素分析基础上的。一般是对未来24～36小时（C对ABDE错）污染物浓度的定量预报。